慢性盘状红斑狼疮使用直接免疫荧光技术可检测出现荧光的是上皮的哪个具体部位
A. 角化层
B. 颗粒层
C. 棘层
D. 基底膜
E. 肌层

正确答案：D。基底膜

解析：慢性盘状红斑狼疮使用直接免疫荧光技术可检测病损部位上皮基底膜区域有免疫球蛋白、补体沉积，形成一条翠绿色的荧光带，又称为“狼疮带”。掌握“口腔扁平苔藓与慢性盘状红斑狼疮”知识点。